在中国药典中，关于药品卫生标准中对染菌数的限度要求的表述，正确的有
A. 口服药品1g或1m1不得检出大肠杆菌，不得检出活螨
B. 化学药品1g含细菌数不得超过1000个，真菌数不得超过100个
C. 液体制剂1m1含细菌数不得超过100个，真菌数和酵母菌数不超过100个
D. 外用药品不进行卫生学检查
E. 外用药品与口服药品的要求相同

正确答案：A、B、C。口服药品1g或1m1不得检出大肠杆菌，不得检出活螨；化学药品1g含细菌数不得超过1000个，真菌数不得超过100个；液体制剂1m1含细菌数不得超过100个，真菌数和酵母菌数不超过100个